关于MBL途径正确的是
A. 是最早被发现的补体激活途径
B. 活化过程需要B因子参与
C. 需要抗原抗体复合物的参与
D. 形成的膜攻击复合物同经典途径相同
E. 不形成经典途径的C5转化酶

正确答案：D。形成的膜攻击复合物同经典途径相同